儿茶粉末用水装置在显微镜下可见大量
A. 棱状结晶
B. 针状结晶
C. 簇状结晶
D. 羽状结晶
E. 柱状结晶

正确答案：B。针状结晶